产后三冲是指
A. 腹痛、便秘、出血
B. 腹痛、便秘、乳汁
C. 腹痛，便秘，饮食
D. 冲肾，冲心，冲肺
E. 冲胃，冲心，冲肺

正确答案：E。冲胃，冲心，冲肺

解析：产后因感染恶露不下等原因会引起三种危急症候，即败血冲心、败血冲胃、败血冲肺，败血即指的是当下而不下的恶露。其中由于心主血脉而藏神，因为产后耗伤血脉，心气大虚，此时败血不下，败血上冲于心，扰乱心神，以致诱发败血冲心之症（E对）。产后三审是指腹痛、便秘、乳汁（B错）。